免疫耐受诱导的难易程度为
A. 胚胎期最难，新生期难，成年期容易
B. 新生期最难，胚胎期难，成年期容易
C. 新生期最难，成年期难，胚胎期容易
D. 成年期最难，胚胎期难，新生期容易
E. 成年期最难，新生期难，胚胎期容易

正确答案：E。成年期最难，新生期难，胚胎期容易